女，35岁。上腹胀伴恶心、呕吐20天。进食后上腹胀明显，恶心，有时呕吐所进食物，无发热。5个月前曾撞伤上腹部。查体：无贫血，无黄染，上腹部隆起，可触及18cm×14cm囊性包块，不活动，无压痛。钡餐透视见胃大弯受压上抬，横结肠下移。最可能的诊断是
A. 胰腺囊肿
B. 腹膜后血肿
C. 胰腺假性囊肿
D. 肠系膜囊肿
E. 胰腺囊腺瘤

正确答案：C。胰腺假性囊肿

解析：青年女性患者，5个月前曾撞伤上腹部（提示可能存在胰腺外伤）。进食后上腹胀明显，恶心，有时呕吐所进食物，无发热。体查：上腹部隆起，可触及18cm×14cm囊性包块，不活动，无压痛（胰腺假性囊肿的典型体征）。钡餐透视见胃大弯受压上抬，横结肠下移（提示胃大弯及横结肠之间存在占位性病变）。综合该患者的病史、体查及影像学检查，最可能的诊断是胰腺假性囊肿（C对）。胰腺囊肿包括真性囊肿、假性囊肿和囊性肿瘤，虽然胰腺假性囊肿属于胰腺囊肿（A错），但本题更准确的答案应为胰腺假性囊肿。腹膜后血肿（P327）（B错）为腹部损伤的常见并发症，突出的表现是内出血征象、腰背痛及肠麻痹。肠系膜囊肿（D错）主要表现为腹胀、腹痛和呕吐，约1/3病人可有腹部移动性包块。胰腺囊腺瘤（E错）是一种少见的胰腺外分泌肿瘤，主要表现为上腹胀痛或隐痛、上腹部包块，可有体重减轻、黄疸、消化道出血和胃肠道症状。